每侧乳腺有多少个腺叶
A. 10～15个
B. 15～20个
C. 20～25个
D. 25～30个
E. 30～35个

正确答案：B。15～20个

解析：乳房腺体由15～20个腺叶组成（B对），每一腺叶分成若干个腺小叶，每一腺小叶又由10～100个腺泡组成，这些腺泡紧密地排列在小乳管周围，腺泡的开口与小乳管相连。